诊断急性链球菌感染后肾小球肾炎的关键指标是
A. IgA升高
B. 肾功能异常
C. 补体下降
D. ASO升高
E. 血沉加快

正确答案：C。补体下降

解析：起病初期血清C3及总补体下降，8周内逐渐恢复正常，对本病具有诊断意义。因此诊断急性肾小球肾炎的关键指标是补体下降（C对）。ASO升高（D错）仅提示近期内曾有过链球菌感染。IgA升高（A错）见于IgA肾病。肾功能异常（B错）、血沉加快（E错）亦无特异性。